服用时应多饮水，同时应碱化尿液以防止尿酸结石形成的药物是
A. 阿仑膦酸钠
B. 氨苄西林
C. 氨茶碱
D. 苯溴马隆
E. 苯海拉明

正确答案：D。苯溴马隆

解析：本题考查痛风治疗药。苯溴马隆（D对）促进尿酸排泄，故服用时应多饮水，同时应碱化尿液以防止尿酸结石。阿仑膦酸钠（A错）用于治疗骨质疏松。氨苄西林（B错）用于敏感致病菌所致的呼吸道感染、泌尿系统感染、消化道感染、耳鼻喉感染、皮肤和软组织感染。氨茶碱（C错）用于治疗支气管哮喘。苯海拉明（E错）用于抗过敏。